温经汤主治证候的病因病机是
A. 五劳虚极
B. 产后血虚受寒
C. 冲任虚损
D. 下焦蓄血
E. 冲任虚寒，瘀血阻滞

正确答案：E。冲任虚寒，瘀血阻滞

解析：本证属于虚、寒、瘀、热兼夹，即阴血亏虚、寒凝、血瘀、虚热，寒热错杂，虚实夹杂，但以寒凝、血瘀为主。冲任虚寒，阴血不足，瘀血寒凝，经脉不利，方用温经散寒，养血祛瘀的温经汤（E对）。